涂剂是指
A. 清洗阴道、尿道的液体制剂
B. 用于咽喉、口腔清洗的液体制剂
C. 专供涂抹、敷于皮肤的外用液体制剂
D. 专供揉搽皮肤表面用的液体制剂
E. 用纱布、棉花蘸取后涂搽皮肤或口、喉部黏膜的液体制剂

正确答案：E。用纱布、棉花蘸取后涂搽皮肤或口、喉部黏膜的液体制剂

解析：本题考查涂剂。涂剂系指含原料药物的水性或油性溶液、乳状液、混悬液，供临床用前用纱布或棉球等软物料蘸取涂与皮肤或口腔与喉部黏膜的液体制剂（E对）；清洗阴道、尿道的液体制剂（A错）为灌洗剂；用于咽喉、口腔清洗的液体制剂（B错）为含漱剂；供涂抹、敷于皮肤的外用液体制剂（C错）为洗剂；揉擦皮肤表面用的液体制剂（D错）为搽剂。